适合分离酸性物质的常用极性吸附剂是
A. 阳离子交换树脂
B. 透析膜
C. 活性炭
D. 硅胶
E. 氧化铝

正确答案：D。硅胶

解析：本题考查的是硅胶吸附色谱法和氧化铝吸附色谱法添加溶剂的选择。适合分离酸性物质的常用极性吸附剂是硅胶（D对）。添加溶剂的选择：为避免发生化学吸附，酸性物质宜用硅胶，碱性物质则宜用氧化铝（E错）进行分离。当然，硅胶、氧化铝用适当方法处理成中性时，情况会有所缓解。通常在分离酸性（或碱性）物质时，洗脱溶剂中分别加入适量乙酸（或氨、吡啶、二乙胺），常可达到防止拖尾、促进分离的效果。阳离子交换树脂（A错）为离子色谱法的固定相。离子色谱法是根据物质解离程度不同进行分离。离子色谱法也称离子交换法，该法系以离子交换树脂作为固定相，以水或含水溶剂作为流动相。中药化学成分中，具有酸性、碱性及两性基团的分子，在水中多呈解离状态，据此可用离子交换法或电泳技术进行分离。透析膜（B错）应用于膜分离法中。膜分离法是一种用天然或人工合成的膜，以外界能量或化学位差为推动力，对双组分或多组分的溶质和溶剂进行分离、分级、提纯或富集的方法。对于生物大分子，一般可以通过透析法对其进行浓缩和精制。活性炭（C错）为活性炭色谱吸附法的吸附剂。活性炭是非极性吸附剂，与硅胶、氧化铝相反，对非极性物质具有较强的亲和能力，在水中对溶质表现出强的吸附能力。溶剂极性降低，则活性炭对溶质的吸附能力也随之降低。故从活性炭上洗脱被吸附物质时，洗脱溶剂的洗脱能力将随溶剂极性的降低而增强。